种植体常用2个螺丝为
A. 封闭螺丝和固位螺丝
B. 修复螺丝和愈合螺丝
C. 封闭螺丝和中央螺丝
D. 固位螺丝和中央螺丝
E. 修复螺丝和中央螺丝

正确答案：A。封闭螺丝和固位螺丝

解析：本题考查种植体修复。种植体常用2个螺丝为封闭螺丝和固位螺丝（A对）。封闭螺丝又称覆盖螺丝，能封闭植入体上方预留连接基台的螺丝孔。固定螺丝又称修复体螺丝，它是将上部结构与种植体的基台相连接的螺丝，可拆换。